某女，51岁。因反复胸闷、胸痛2年余就诊，2年前因琐事与人争吵后，出现左前胸胀痛，伴胸胁胀痛，心悸，休息后缓解，未予重视。此后，胸闷胸痛反复发作，多于情绪波动后症状加重，严重时可放射至左后肩。患者情志抑郁，善太息，纳差，寐欠安，小便黄，大便失调，唇舌紫暗，脉弦涩。既往有慢性乙型肝炎10余年，对酒精过敏。临床给予血脂、肝肾功能、心肌酶谱、心电图及平板运动试验等检查。西医诊断为冠心病心绞痛；中医诊断为胸痹，辨证为气滞血瘀证。处方如下：中药汤剂：柴胡10g，赤芍10g，炒枳壳10g，生甘草10g，桃仁10g，红花9g，生地黄15g，川牛膝10g，当归9g，党参15g，炙乳没（各）6g，桔梗9g，川楝子15g，延胡索粉（分冲）3g。共5剂，水煎服，每日1剂，早、晚分服。中成药：血府逐瘀口服液10ml×12支，每次10ml，3次/日；复方丹参滴丸25mg×100丸，10丸/次，3次/日；速效救心丸40mg×100丸，舌下含服10粒，必要时服用；茵栀黄口服液10ml×10支，每次10ml，3次/日。执业药师给该患者发放药品的用药交代中正确的是
A. 中药汤剂每日1剂，每剂煎煮两次，每次服用400ml
B. 所服汤剂及成药中含赤芍、生地黄、冰片等寒凉之品，服药期间应忌食生冷
C. 中药汤剂对胃肠有轻微刺激，应在早、晚餐前服用
D. 复方丹参滴丸必须舌下含服，每次10丸，每日3次，长期服用
E. 速效救心丸应舌下含服，每次10丸，每日3次

正确答案：B。所服汤剂及成药中含赤芍、生地黄、冰片等寒凉之品，服药期间应忌食生冷

解析：本题考查的是饮片的用药禁忌。所服汤剂及成药中含赤芍、生地黄、冰片等寒凉之品，服药期间应忌食生冷（B对）。寒性病服温热药时要忌生冷食物；热性病服寒凉药时要忌食辛辣食物。服镇静安神药时，忌食辛辣、酒、浓茶等刺激和兴奋中枢神经的食物。服人参等滋补药时要忌饮茶，高热患者忌食油。另外，由于疾病关系，在服药期间，凡属生冷、黏腻、腥臭等不易消化及有特殊刺激的食物，都应根据病情予以避免。中药汤剂每日1剂，每剂煎煮2次，每剂药的总煎出量：成人400～600ml，儿童100～300ml，分2～3次服用（A错）。对胃肠有刺激或欲使药力停留上焦较久的药宜在饭后服（C错）。复方丹参滴丸25mg×100丸，10丸/次，3次/日（D错）。速效救心丸40mg×100丸，舌下含服10粒，必要时服用（E错）。